某女，58岁。既患有心烦失眠，又患有内热消渴，宜选用的药物是
A. 龟甲
B. 南沙参
C. 天冬
D. 阿胶
E. 麦冬

正确答案：E。麦冬

解析：本题考查的是麦冬的主治病证。既患有心烦失眠，又患有内热消渴，宜选用的药物是麦冬（E对）。麦冬：【主治病证】（1）肺热燥咳痰黏，阴虚劳嗽咯血。（2）津伤口渴，内热消渴。（3）心阴虚、心火旺之心烦失眠。（4）肠燥便秘。龟甲（A错）：【主治病证】（1）阴虚阳亢之头晕目眩，热病伤阴之虚风内动。（2）阴虚发热。（3）肾虚腰膝痿弱、筋骨不健、小儿囟门不合。（4）心血不足之心悸、失眠、健忘。（5）血热崩漏、月经过多。南沙参（B错）：【主治病证】（1）肺热燥咳有痰，阴虚劳嗽咯血。（2）气阴两伤之舌干口渴。天冬（C错）：【主治病证】（1）肺热燥咳，顿咳痰黏，劳嗽咯血。（2）骨蒸潮热，津伤口渴，阴虚消渴。（3）肠燥便秘。阿胶（D错）：【主治病证】（1）血虚眩晕、心悸。（2）吐血，衄血，便血，崩漏，妊娠胎漏。（3）阴虚燥咳或虚劳喘咳。（4）阴虚心烦、失眠。